诊断腺泡细胞的特异性标记物
A. 细胞角蛋白
B. 淀粉酶
C. alponin
D. CEA
E. S-100蛋白

正确答案：B。淀粉酶

解析：本题考查腺泡细胞的特异性标记物。诊断腺泡细胞的特异性标记物为淀粉酶（B对）。腺泡分为浆液性、黏液性和混合性三种类型。光镜下，浆液细胞呈锥体形，基底部较宽，附于基膜上，顶端向着腺腔内。胞质嗜碱性，含PAS阳性的分泌颗粒即酶原颗粒，其直径约为 1um。当细胞分泌时,分泌颗粒减少，同时细胞体积变小，胞核增大，核仁明显。浆液细胞主要表达α-淀粉酶。